属于DPP-4抑制剂的药物是
A. 伏格列波糖
B. 那格列奈
C. 利拉鲁肽
D. 阿格列汀
E. 格列吡嗪

正确答案：D。阿格列汀

解析：本题考查DPP-4抑制剂。二肽基肽酶-4（DPP-4）抑制剂代表药为阿格列汀（D对）。伏格列波糖（A错）为α-葡萄糖苷酶抑制剂。那格列奈（B错）为非磺酰脲类促胰岛分泌药。利拉鲁肽（C错）为胰高糖素样肽-1（GLP-1）受体激动剂。格列吡嗪（E错）为磺酰脲类促胰岛素分泌药。